女，28岁，间歇性牙龈出血1年。体检：双下肢可见散在出血点及紫斑，肝脾不大，余无异常。血红蛋白110g/L，红细胞42×1012/L，白细胞60×109/L，分类正常，血小板28×109/L。为确诊，应先做哪项检查
A. 抗核抗体检查
B. 出血时间
C. 凝血时间
D. 骨髓象检查
E. Coombs试验

正确答案：D。骨髓象检查

解析：特发性血小板减少性紫癜诊断要点：至少2次化验血小板计数减少，血细胞形态无异常；体检脾脏一般不增大；骨髓检查巨核细胞数量正常或增多，有成熟障碍。掌握“特发性血小板减少性紫癜（ITP）”知识点。